下列组成药物中含有生黄芪与当归的方剂是
A. 仙方活命饮
B. 四妙勇安汤
C. 透脓散
D. 阳和汤
E. 复元活血汤

正确答案：C。透脓散

解析：本题考查透脓散的药物组成。透脓散由生黄芪12g、当归6g、穿山甲（炒）3g、皂角刺5g、川芎9g组成（C对）。仙方活命饮的药物组成有白芷、贝母、防风、赤芍药、当归尾、甘草节、皂角刺(炒)、穿山甲(炙)、天花粉、乳香、没药、金银花、陈皮（A错）。四妙勇安汤的药物组成有金银花、玄参、当归、甘草（B错）。阳和汤的药物组成有熟地、肉桂、白芥子、姜炭、生甘草、麻黄、鹿角胶（D错）。复元活血汤的药物组成有柴胡、瓜蒌根、当归、红花、甘草、穿山甲、大黄、桃仁（E错）。